关于心脏位置的说法，正确的是
A. 位于胸膜腔内
B. 位于四分法的前纵隔内
C. 位于膈肌的上方
D. 2/3位于中线的右侧
E. 位于四分法的上纵隔内

正确答案：C。位于膈肌的上方

解析：心脏位于胸腔的中纵隔内（ABE错）。位于膈肌的上方（C对）。心约2/3位于正中线的左侧（D错），1/3位于正中线的右侧。